服用阿司匹林可增加患者消化道黏膜损伤和胃溃疡的风险，为降低此风险，应采取的措施是
A. 不推荐65岁以上老年患者使用阿司匹林进行冠心病二级预防
B. 阿司匹林不应与其它抗血小板药物合用
C. 使用阿司匹林前宜先根治幽门螺杆菌感染
D. 应长期合用质子泵抑制剂
E. 尽量避免使用阿司匹林换用氯吡格雷

正确答案：C。使用阿司匹林前宜先根治幽门螺杆菌感染

解析：本题考查降低阿司匹林服用后消化道黏膜损伤和胃溃疡的风险的措施。服用阿司匹林可增加患者消化道黏膜损伤和胃溃疡的风险，为降低此风险，应采取的措施是使用阿司匹林前宜先根治幽门螺杆菌感染（C对）。为减少阿司匹林的消化道黏膜损伤，应注意做到：（1）不推荐55岁以下女性服用阿司匹林预防脑卒中；也不推荐45岁以下男性服用阿司匹林预防心肌梗死；不推荐85岁以上高龄者应用阿司匹林（A错）。（2）长期应用阿司匹林、氯吡格雷与华法林时，应将剂量调至最低。（3）注意监测出血。（4）服用前宜先根治幽门螺杆菌(HP）感染。（5）同时联合服用胃黏膜保护剂硫糖铝、米索前列醇、雷尼替丁。（6）对不能耐受阿司匹林者、糖尿病者、高胆固醇血症和以前进行过心脏手术者，应用氯吡格雷安全有效，对有不稳定型心绞痛或非Q波心肌梗死者，氯吡格雷可有效减少危险（E错）。阿司匹林与其它抗血小板及抗凝药物合用（B错），可以大幅度减少病死率和致残率。为降低此风险，应同时联合服用胃黏膜保护剂而不是质子泵抑制剂（D错）。